下列化学物中属于职业性致癌因素的是
A. 甲苯
B. 苯
C. 丁酮
D. 甲醇
E. 二硫化碳

正确答案：B。苯